在中药的酸水提取液中加碘化铋钾试剂，能生成橘红色沉淀的有
A. 木脂素
B. 黄酮
C. 蒽醌
D. 生物碱
E. 肽类

正确答案：D、E。生物碱；肽类

解析：本题考查的是生物碱的沉淀反应。在中药的酸水提取液中加碘化铋钾试剂，能生成橘红色沉淀的有生物碱（D对）与肽类（E对）。大多数生物碱在酸水或稀醇中与某些试剂反应生成难溶于水的络合物或复盐，这一反应称为生物碱沉淀反应，这些试剂称为生物碱沉淀试剂。常用的生物碱沉淀试剂有碘化铋钾试剂、碘化汞钾试剂、碘-碘化钾试剂、硅钨酸试剂、饱和苦味酸试剂、雷氏铵盐试剂等。其中生物碱与碘-碘化钾试剂反应生成红棕色无定形沉淀。但同时应注意的是，植物的酸水提取液中常含有蛋白质、多肽、氨基酸、鞣质等一些非生物碱类成分，它们也能与生物碱沉淀试剂作用产生沉淀。为避免此类干扰，提高检测的准确性，可将酸水液碱化后以三氯甲烷萃取出游离生物碱，使之与蛋白质等水溶性杂质分离，然后再用酸水自三氯甲烷溶液中萃取出生物碱，以此酸水液进行沉淀反应。木脂素（A错）分子中常用的官能团为醇羟基、酚羟基、甲氧基、亚甲二氧基、羧基和内酯环，因此它也具有这些官能团所具有的化学性质。如Labat反应等。黄酮类（B错）化合物的显色反应：黄酮类化合物的显色反应多与分子中的酚羟基及γ-吡喃酮环有关。1.还原试验：（1）盐酸-镁粉（或锌粉）反应；（2）四氢硼钠（钾）反应；2.金属盐类试剂的络合反应：（1）铝盐；（2）铅盐；（3）锆盐；（4）镁盐；（5）氯化锶；（6）三氯化铁；3.硼酸显色反应；4.碱性试剂显色反应。蒽醌（D错）属于醌类化合物。醌类化合物的显色反应：1.Feigl反应；2.无色亚甲蓝显色试验；3.Bornträger's反应；4.Kesting-Craven反应；5.与金属离子的反应。。